下列不符合房颤听诊特点的是
A. 心律完全不规则
B. 脉搏短绌
C. 心音强弱绝对不一致
D. 常可闻及心脏杂音
E. 心率快慢不一

正确答案：D。常可闻及心脏杂音

解析：心房颤动的听诊特点是心律绝对不规则、第一心音强弱不等和脉心搏短绌（ABCE对）。心脏杂音多见于心脏瓣膜病（D错，为本题正确答案）。